根据牙与下颌升支及第二磨牙的关系，阻生齿完全位于升支内时称为
A. 第Ⅱ类阻生
B. 第Ⅲ类阻生
C. 中位阻生
D. 低位阻生
E. 近中阻生

正确答案：B。第Ⅲ类阻生

解析：本题考查阻生牙的类型。根据牙与下颌升支及第二磨牙的关系，阻生齿完全位于升支内时称为第Ⅲ类阻生（B对）。1.根据牙与下颌升支及第二磨牙的关系，分为Ⅰ类、Ⅱ类、Ⅲ类3类，Ⅰ类阻生指下颌升支及第二磨牙远中面之间有足够间隙容纳第三磨牙牙冠的近远中径；Ⅱ类阻生是指下颌支前缘与第二磨牙远中面之间的间隙不大，不能容纳第三磨牙的近远中径（A错）；阻生齿完全位于升支内时称为Ⅲ类阻生，一般指第三磨牙的全部或大部分位于下颌支内。2.根据阻生牙相对于第二磨牙（牙合）平面的位置关系分为以下三种：高位阻生：牙的（牙合）平面到达或高于第二磨牙的（牙合）平面；中位阻生（C错）：牙的（牙合）平面位于第二磨牙的（牙合）平面和牙颈线之间；低位阻生（D错）：牙的（牙合）平面低于第二磨牙的牙颈线。3.Winter根据阻生智牙的长轴与第二磨牙长轴的关系可分成垂直阻生、水平阻生、近中阻生（E错）、远中阻生、颊向阻生、舌向阻生、倒置阻生。